下面关于学校卫生监督说法，不正确的是
A. 学校卫生监督以经常性卫生监督为核心
B. 学校卫生标准是进行预防性、经常性卫生监督的重要技术依据
C. 经常性卫生监督是指监督员对学校日常卫生工作进行的现场监督检查活动
D. 经常性卫生监督应按轻重缓急，分期、分批进行，保证监督收到实效
E. 预防性卫生监督的主要任务是依据国家有关法律、法规、条例和卫生标准，对新、改、扩建学校，各种儿童少年文化体育活动场所等进行卫生审查

正确答案：A。学校卫生监督以经常性卫生监督为核心